下列符合急性心包炎胸痛临床特点的是
A. 疼痛不放射
B. 随渗液量的增多而加重
C. 吞咽动作时减轻
D. 深呼吸时减轻
E. 咳嗽时加重

正确答案：E。咳嗽时加重

解析：急性心包炎为心包脏层和壁层的急性炎症性疾病。疼痛可放射到颈部、左肩、左臂，也可达上腹部（A错），疼痛性质尖锐，与呼吸运动相关，渗液量增多，疼痛会减轻（B错），常因咳嗽（E对）、深呼吸（D错）、变换体位或吞咽动作（C错）而加重。